甲型强心苷的紫外最大吸收是在
A. 217～220nm
B. 270～278nm
C. 300～330nm
D. 254～270nm
E. 300～345nm

正确答案：A。217～220nm